2.5
A. 不能，因为12.3小于24.0
B. 需作两样本比较的单侧t检验才能确定
C. 需作两样本比较的双侧t检验才能确定
D. 需作两样本比较的单侧u检验才能确定
E. 需作两样本比较的双侧u检验才能确定

正确答案：C。需作两样本比较的双侧t检验才能确定

解析：本题中的数据分别是服用甲乙两药后的血压下降值总体中的样本，要比较两种降压药疗效是否一样还需作两样本比较的双侧t检验才能确定（C对）。假设检验包括原假设和备择假设，其中备择假设又包括单侧假设和双侧假设。题中比较两降压药的疗效，因无法判断两种药物的优劣，应选用双侧检验。两样本服从正态分布，样本量均为30，当σ未知且n较小，两样本均数比较适宜用t检验。μ检验的适用条件：σ未知但n足够大（n＞100）或σ已知。